治疗有机磷农药中毒毒蕈碱样症状的药物是
A. 阿托品
B. 氯磷定
C. 利多卡因
D. 对甲硝唑（灭滴灵）
E. 双复磷

正确答案：A。阿托品

解析：毒蕈碱样症状又称为M样症状，表现为瞳孔收缩、视力模糊、血压下降、心动过缓、出汗、支气管平滑肌收缩、呼吸困难、恶心、呕吐等，阿托品（A对）可有效对抗有机磷酸酯中毒时毒蕈碱样症状，大剂量也能解除部分中枢症状，并可兴奋呼吸中枢。氯磷定（B错）、双复磷均属于胆碱酯酶复活剂，氯解磷定进入体内与磷酰化胆碱酯酶结合，形成磷酰化氯解磷定释放胆碱酯酶，临床可用于中、重度有机磷酸酯类中毒的解救。利多卡因（C错）主要用于室性心律失常，如心脏手术、心导管术、急性心肌梗死或强心苷中毒所致的室性心动过速或心室纤颤。对甲硝唑（D错）又称为灭滴灵，临床主要用于阴道毛滴虫所致的阴道炎、尿道炎和前列腺炎。双复磷（E错）作用与氯解磷定相似，作用较强，且易通过血脑屏障，对M样、N样及中枢症状都有一定疗效。